有关心包的描述错误的是
A. 分为纤维性心包心包和浆膜性心包
B. 浆膜性心包分脏、壁二层
C. 纤维层与浆膜层共同围成心包腔
D. 心包腔内有少量浆液
E. 心包腔内的浆液起润滑作用

正确答案：C。纤维层与浆膜层共同围成心包腔

解析：心包分为纤维性心包心包和浆膜性心包（A对）。浆膜性心包分脏、壁二层（B对）。浆膜心包的脏、壁两层（C错，为本题正确答案）在出入心的大血管的根部互相移行，两层之间的潜在性腔隙称心包腔。心包腔内有少量浆液（D对）起润滑作用（E对）。